以下哪一种疾病愈合后一般不留瘢痕
A. 腺周口疮
B. 带状疱疹
C. 口腔黏膜纤维性变
D. 白塞病中的生殖器溃疡
E. 褥疮性溃疡

正确答案：B。带状疱疹

解析：本题考查带状疱疹。带状疱疹（B对）愈合后一般不留瘢痕。溃疡按其破坏组织的程度，可分为浅层溃疡和深层溃疡，浅层溃疡只破坏上皮层，愈合后不留瘢痕；而深层溃疡则病变波及黏膜下层，愈合后遗留瘢痕。带状疱疹形成浅表溃疡。腺周口疮的溃疡（A错）深达黏膜下层腺体及腺周组织，故可形成瘢痕。口腔黏膜下纤维性变（C错）的黏膜下层胶原纤维堆积、变性。白塞病中的生殖器溃疡（D错）累及黏膜下层血管及血管周围。褥疮性溃疡（E错）溃疡累及黏膜下层。